女孩，1岁，发热伴咳嗽4天，查体：T38.8℃，P128次/分，R38次/分，双肺闻及固定的湿啰音，腹稍胀，肝肋下2cm，实验室检查，血WBC13.5×10⁹/L,N0.72,L0.18最可能的诊断是
A. 支气管肺炎
B. 支气管炎
C. 大叶性肺炎
D. 间质性肺炎
E. 毛细支气管炎

正确答案：A。支气管肺炎

解析：女孩，1岁，发热伴咳嗽4天，呼吸加快，双肺闻及固定的湿啰音，血WBC13.5×10⁹/L,N0.72，结合患者的年龄，表现，查体和辅检，符合支气管肺炎（A对）。支气管炎大多先有上呼吸道感染症状，主要表现为咳嗽，开始可为干咳，后可有痰。婴幼儿症状较重，常有发热、呕吐及腹泻等，一般无全身症状，故除外（B错）。大叶性肺炎和间质性肺炎双肺呼吸音粗糙，可有不固定的散在的干啰音和粗中湿啰音，故该患儿不考虑此病（CD错）。毛细支气管炎喘息和肺部哮鸣音为其突出表现，该患者无此表现，故除外（E错）。